瞳孔对光反射中枢在
A. 上丘
B. 下丘
C. 上丘臂
D. 下丘臂
E. 顶盖前区

正确答案：E。顶盖前区

解析：瞳孔对光反射中枢在顶盖前区（E对）。瞳孔对光反射的通路如下：视网膜—视神经一视交叉一视束一上丘臂一顶盖前区一两侧动眼神经副核一动眼神经一睫状神经节一节后纤维一瞳孔括约肌收缩一两侧瞳孔缩小。